下列关于乳牙髓腔形态特点的叙述中，正确的是
A. 髓室顶和髓角多位于牙冠中部
B. 乳前牙髓腔与其牙冠外形相似
C. 乳前牙髓腔根管多为单根管
D. 乳前牙髓腔偶见下颌乳切牙根管分为唇、舌向2个根管
E. 以上均正确

正确答案：E。以上均正确

解析：本题考查乳牙髓腔的形态特点。乳牙髓室顶和髓角多位于牙冠中部（A对）。乳牙的髓腔形态与乳牙的外形相似，但髓腔较大，在制备洞形时，应注意保护牙髓，防止穿髓。乳牙髓腔壁薄，从髓腔壁至牙体表面的距离相对于恒牙相应距离较小。髓室顶和髓角多位于牙冠中部。乳前牙髓腔与其牙冠外形相似（B对），根管多为单根管（C对），偶见下颌乳切牙根管分为唇、舌向2个根管（D对）。乳磨牙髓室较大，通常均有3个根管：上颌乳磨牙有2个颊侧根管，1个舌侧根管；下颌乳磨牙有两个近中根管，1个远中根管。下颌第二乳磨牙有时可出现4个根管，分布为近中两个根管，远中两个根管。综上所述，以上均正确（E对，为本题正确答案）。